属于免疫治疗的是
A. 抑制治疗
B. 主动免疫治疗
C. 被动免疫治疗
D. 非特异免疫治疗
E. 以上说法均正确

正确答案：E。以上说法均正确

解析：免疫治疗分为免疫增强或抑制治疗、主动或被动免疫治疗、特异或非特异免疫治疗。掌握“免疫预防及免疫治疗”知识点。